节制索位于
A. 右心房
B. 右心室
C. 左心房
D. 左心室
E. 房间隔

正确答案：B。右心室

解析：右心室（B对）内有节制索即隔缘肉柱，其形成右心室流入道的下界，有防止心室过度扩张的功能。